毛果芸香碱可治疗
A. 青光眼
B. 阵发性室上性心动过速
C. 有机磷酸酯类中毒
D. 琥珀胆碱过量中毒
E. 房室传导阻滞

正确答案：A。青光眼

解析：毛果芸香碱能直接作用于副交感神经（包括支配汗腺交感神经）节后纤维支配的效应器官的M胆碱受体，尤其对眼和腺体作用明显。对眼的作用有：缩瞳、降低眼内压和调节痉挛；对腺体：促进腺体分泌。临床应用于：青光眼、虹膜睫状体炎（A对）。